以下关于癌症患者营养防治的内容错误的说法是
A. 限制摄入高能量密度的食物
B. 适当食用红肉，避免加工的肉制品摄入
C. 限制含酒精饮料
D. 限制盐的摄入量
E. 避免发霉的谷类和豆类

正确答案：B。适当食用红肉，避免加工的肉制品摄入